关于自然流产母体因素的说法错误的是
A. 全身性疾病
B. 生殖器官异常
C. 内分泌异常
D. 染色体异常
E. 强烈应激

正确答案：D。染色体异常